为达到良好的抗力形，下列哪一条不利于抗力
A. 窝洞要在牙本质有一定深度
B. 窝洞要求呈盒形
C. 去除空悬釉质
D. 入口小而底部大的洞形

正确答案：D。入口小而底部大的洞形

解析：本题考查窝洞的抗力形。入口小而底部大的洞形易形成无基釉，承受咬合力时易折裂，不利于抗力（D错，为本题的正确答案）。窝洞要在牙本质有一定的深度，使充填体有足够的厚度，在承受咀嚼压力时不会折断（A对）。盒状洞形可使咬合力均匀分布，避免产生应力集中（B对）。无基釉缺乏牙本质支持，在承受咬合力时易折裂，去除悬空釉质可增强牙齿抗力（C对）。